成熟的骨组织替代不成熟骨质，重建过程基本完成，出现正常骨结构在
A. 3～6个月
B. 3～4天
C. 5～8天
D. 24～35天
E. 38天以后

正确答案：A。3～6个月

解析：3～6个月后重建过程基本完成，出现正常骨结构。掌握“牙拔除术前准备、器械、心血管及拔牙愈合过程”知识点。